外科疾病辨证的总纲是
A. 脏腑
B. 经络
C. 气血
D. 阴阳
E. 局部

正确答案：D。阴阳

解析：外科疾病辨证包括阴阳辨证、部位辨证、经络辨证、局部辨证。脏腑辨证多见于内科、妇科、儿科疾病（A错）。经络是体表组织与脏腑器官间的重要联络渠道。经络辨证能更好地反应脏腑动能、疾病传变及指导用药，但无法起到总纲的作用（B错）。气血辨证不是外科疾患的主要辨证方法（C错）。阴阳是八纲辨证的总纲。一般来讲，在辨清疾病的表、里、寒、热、虚、实滞后，即可判明是阴证还是阳证，或半阴半阳证。但外科在辨别阴阳属性上还有自己的特点，即根据疾病的发生、发展、症状和转归等各方面的相对性，可直接辨认其为阳证或阴证。外科疾病的阴证和阳证确有一定的独立性，后世医家将阴证阳证放在外科八纲辨证的第一位，阴阳不仅是八纲辨证的总纲，也是其他一切外科疾病辨证的总纲（D对）。局部病灶的存在是外科疾患最显著的特征，因此局部辨证是外科疾病辨证重要的一部分，但在以局部为重点的情况下，也得从整体观念出发，局部与全身辨证相结合，故不能作为总纲（E错）。